钩端螺旋体病原治疗首选
A. 头孢菌素
B. 链霉素
C. 四环素
D. 青霉素
E. 红霉素

正确答案：D。青霉素

解析：钩端螺旋体能引起人及动物的钩端螺旋体病，是一种广泛流行的人畜共患病。对钩端螺旋体引起的感染首选药物青霉素（D对）。头孢菌素（A错）（P373）属于β-内酰胺类抗生素，主要用于革兰阳性菌及革兰阴性菌的治疗。链霉素（B错）（P388）为氨基糖苷类抗生素，对土拉病菌和鼠疫有特效。四环素（C错）（P391）属于四环素类抗生素，由于耐药菌株日益增多和药物的不良反应，现一般不用做首选药。红霉素（E错）（P379）属于大环内酯类抗生素，对革兰染色阳性菌的金黄色葡萄球菌、表皮葡萄球菌、链球菌等抗菌作用强。